临床上不易诊查出的继发龋可用下列哪些方法帮助诊断
A. 探诊
B. 温度测验
C. X线
D. 染色法
E. 麻醉法

正确答案：C。X线

解析：本题考查继发龋的检查。临床上不易诊查出的继发龋可用X线（C对）帮助诊断。继发龋比较隐蔽，临床上不易查出，可用X线片帮助诊断。继发龋由于充填材料的覆盖，用探针不易检查（A错）。温度测验主要用于牙髓活力的测验，以判断牙髓的状况（B错）。染色法适用于牙隐裂，用碘酊浸染，有助于裂隙的发现（D错）。麻醉法是用麻醉的方法判定引起疼痛的患牙（E错）。